《医疗废物管理条例》规定，医疗废物暂时贮存的时间不得超过
A. 1天
B. 2天
C. 3天
D. 4天
E. 5天

正确答案：B。2天